温经汤中配伍桂枝的作用是
A. 解肌发表
B. 温通血脉
C. 调和营卫
D. 温阳散寒
E. 降逆平冲

正确答案：B。温通血脉

解析：根据考点还原可作出判断。温经汤中配伍桂枝的作用是温通血脉（B对）。解肌发表是麻黄汤、桂枝汤中桂枝的作用（A错）。调和营卫是桂枝汤中桂枝得芍药的作用（C错）。温阳散寒是桂枝加芍药汤中桂枝的作用（D错）。降逆平冲是桂枝加桂汤中桂枝的作用（E错）。